诊断脑出血最迅速、最可靠的检查是
A. 脑血管造影
B. 脑电图
C. 脑脊液检测
D. 头颅MRI
E. 头颅CT

正确答案：E。头颅CT

解析：诊断脑出血最迅速、最可靠的检查是头颅CT（E对），可清楚显示出血部位、出血量大小、血肿形态、是否破入脑室以及血肿周围有无低密度水肿带和占位效应等。脑血管造影（A错）主要用于脑血管病检查，特别是对于动脉瘤、动静脉畸形等定性定位诊断。脑电图（B错）主要针对癫痫患者检测。脑脊液检测（C错）易引起脑疝形成，如需排除颅内感染和蛛网膜下腔出血，可谨慎使用。头颅MRI（D错）对发现结构异常及明确出血的病因有帮助，对急性脑出血诊断不及CT。